麻疹粘膜斑是指
A. 颊粘膜出现蓝黑色色素沉着斑片
B. 颊粘膜出现血肿
C. 颊粘膜出现瘀斑
D. 颊粘膜有散在点状白膜
E. 在第二磨牙的颊粘膜处见到针头大小白色斑点

正确答案：E。在第二磨牙的颊粘膜处见到针头大小白色斑点

解析：麻疹起病第2～3天，可在第二磨牙的颊粘膜处见到针头大小白色斑点（E对），为麻疹黏膜斑，直径0.5～1mm，周围有红晕，1～2天内可迅速增多融合。